乳牙龋的常见类型
A. 急性龋、干性龋、环状龋
B. 慢性龋、静止性龋、奶瓶龋
C. 急性龋、环状龋、奶瓶龋
D. 奶瓶龋、干性龋、环状龋
E. 湿性龋、环状龋、慢性龋

正确答案：C。急性龋、环状龋、奶瓶龋

解析：本题考查乳牙龋。乳牙龋的常见类型有急性龋、环状龋、奶瓶龋（C对）。1.低龄儿童龋：又称婴幼儿龋，是指婴幼儿和学龄前儿童发生的龋病。该病的特点是主要侵害上颌乳前牙及乳磨牙。2.奶瓶龋或喂养龋：是指长时间用奶瓶喂养或母乳喂养的婴幼儿所容易罹患的龋病。一些孩子喜欢在睡眠、半睡眠状态下持久地叼着奶嘴或乳头，吸吮的是含有大量糖分的乳汁或饮料，直接浸泡着牙面。此时唾液分泌减少，口腔自洁作用差，牙面极容易被细菌产酸所腐蚀。受累的主要是上前牙唇面、邻面及舌面。3.环状龋：乳前牙唇面、邻面龋损较快发展成围绕牙冠的广泛性的环形龋。环状龋多位于冠中1/3至颈1/3处。其发生与牙颈部菌斑易积聚及自洁作用差有关；一些研究还证实乳牙颈部出生后釉质的矿化程度较低。4.猖獗性龋：指突然发生；涉及牙位广泛且不好发的牙位，如：下颌乳前牙亦受累；迅速地形成龋洞；迅速波及牙髓。